强心苷甾体母核C-10位常见的取代基有
A. 甲基
B. 醛基
C. 羟甲基
D. 羧基
E. 氨基

正确答案：A、B、C、D。甲基；醛基；羟甲基；羧基

解析：本题考查的是强心苷的结构。强心苷甾体母核C-10位常见的取代基有甲基（A对）、醛基（B对）、羟甲基（C对）与羧基（D对）。强心苷元部分的结构特征：强心苷由强心苷元与糖缩合而成。天然存在的强心苷元是C₁₇侧链为不饱和内酯环的甾体化合物。其结构特点如下。①甾体母核A、B、C、D四个环的稠合方式为A/B环有顺、反两种形式，但多为顺式；B/C环均为反式；C/D环多为顺式。②甾体母核C-10、C-13、C-17的取代基均为β型。C-10多有甲基或醛基、羟甲基、羧基等含氧基团，C-13为甲基取代，C-17为不饱和内酯环取代。C-3、C-14位有羟基取代，C-3羟基多数是β构型，少数是α构型，强心苷中的糖常与C-3羟基缩合成苷。C-14羟基均为β构型。有的母核含有双键，双键常在C-4、C-5位或C-5、C-6位。